目前法定传染病的病原体中不包括的是
A. 立克次体
B. 细菌
C. 原虫
D. 弓形虫
E. 病毒

正确答案：D。弓形虫

解析：弓形虫（D错，为本题正确答案）寄生于细胞内，随血液流动，到达全身各部位，破坏大脑、心脏、眼底，致使人的免疫力下降，患各种疾病，不属于目前法定传染病病原体。传染病是指由各种病原体引起的能在人与人、动物与动物或人与动物之间相互传播的一类疾病。病原体可以是微生物或寄生虫，包括病毒（E对）、立克次体（A对）、细菌（B对）、真菌、螺旋体、原虫（C对）等。